室间隔缺损的先天性心脏病的主要杂音是
A. 第2肋间Ⅱ级柔和的收缩期杂音
B. 第4肋间Ⅱ级柔和的舒张期杂音
C. 第2肋间Ⅱ级柔和的舒张期杂音
D. 第4肋间Ⅳ级粗糙的收缩期杂音
E. 第4肋间Ⅳ级粗糙的舒张期杂音

正确答案：D。第4肋间Ⅳ级粗糙的收缩期杂音

解析：室间隔缺损的先天性心脏病的主要可闻及第4肋间Ⅳ级粗糙的收缩期杂音（D对）。心脏听诊对鉴别先天性心脏病有重要意义，我们可以将这些心脏杂音总结到一起，方便记忆。①室间隔缺损：可闻及胸骨左缘3~4肋间的Ⅲ~Ⅳ级粗糙的全收缩期杂音，并伴有P2亢进。分流量大时，在心尖区（锁骨中线旁第5肋间）可有二尖瓣相对狭窄的较柔和的舒张中期杂音。②房间隔缺损：可闻及左第二肋间近胸骨旁的Ⅱ～Ⅲ级喷射性收缩期杂音，同时伴有第一心音亢进和P2增强和固定分裂。③动脉导管未闭：在胸骨左缘上方可闻及占整个收缩期和舒张期的连续性“机械性”杂音，并伴有P2亢进。当肺血管阻力增高时，杂音的舒张期成分可能是减弱或消失。④肺动脉狭窄：可闻及胸骨左缘上部有洪亮的Ⅳ～Ⅵ级以上喷射性收缩期杂音，向左上胸、心前区、颈部、腋下及背面传导。并伴有第二心音亢进和分裂。⑤法洛氏四联症：胸骨左缘第2～4肋间可闻及Ⅱ～Ⅲ级粗糙喷射性收缩期杂音。部分患儿可闻及P2亢进。